男，28岁。左侧小腿上段皮肤窦道反复流脓，排出碎骨块3年。近2日发热，局部红肿、剧痛、有波动感。X线检查示左胫骨上端增粗，见死骨，周围有新生骨，无包壳形成。在应用抗生素的同时应给予
A. 病灶刮除、植骨
B. 死骨摘除术
C. 切开引流
D. 穿刺抽脓
E. 抗结核药物

正确答案：C。切开引流

解析：患者左侧小腿上段皮肤窦道反复流脓，排出碎骨块3年（慢性骨髓炎典型表现），X线示左胫骨上端增粗，见死骨，周围有新生骨（慢性骨髓炎典型影像学表现表现），结合患者病史、症状及影像学表现，该患者最可能的诊断为慢性骨髓炎。近2日发热，局部红肿、剧痛、有波动感，考虑慢性骨髓炎急性发作。慢性骨髓炎急性发作时不宜作病灶死骨摘除术，应以抗生素治疗为主，积脓时宜切开引流（C对）。病灶刮除植骨（A错）仅在慢性炎症期可行，可清除死骨、炎性肉芽组织和消灭无效腔。由于患者尚无骨性包壳形成，所以不应进行死骨摘除术（B错），以免造成长段骨缺损。穿刺抽脓（D错）有导致新窦道形成的风险。抗结核药物（E错）用于治疗结核杆菌感染，而慢性骨髓炎的主要致病菌为金黄色葡萄球菌和乙型溶血性链球菌，故无需使用。